老年男性，腹股沟内侧半球形肿块，压住内环仍可突出，可能是
A. 腹股沟斜疝
B. 腹股沟直疝
C. 股疝
D. 睾丸鞘膜积液
E. 隐睾

正确答案：B。腹股沟直疝

解析：腹股沟直疝多见于老年体弱者，经腹股沟三角（其外侧边是腹壁细动脉，内侧边为腹直肌外侧缘，底边为腹股沟韧带）直接由后向前突出，不进入阴囊。多呈半球形，基底部宽，回纳疝块后压住内环疝块仍突出（B对）。腹股沟斜疝（A错）多见儿童及青壮年，经腹股沟管突出，由外上向内下前斜行进入阴囊，回纳疝块后压住内环疝块不再突出。股疝（C错）多发于中年以上妇女，最易嵌顿，经股管向卵圆窝突出的疝。睾丸鞘膜积液主要表现为阴囊内逐渐增大肿物，一般无痛，有下坠感（D错）。隐睾主要表现为患侧阴囊扁平，单侧者左、右侧阴囊不对称，双侧隐睾阴囊空虚、瘪陷（E错）。